患者，男，3岁。发烧2天，突然神志不清，痉挛抽搐。用药宜首选
A. 青黛
B. 夏枯草
C. 栀子
D. 大青叶
E. 薄荷

正确答案：A。青黛

解析：三岁男患，发烧两天，出现痉挛抽搐，为小儿惊痫，而青黛，苦寒清泄，咸入血分，入肝经，能清泻肝火而定惊痫，因此应当选择清热解毒，泻火定惊的青黛（A对）。夏枯草（B错）的功效是清热泻火，明目，散结消肿。栀子（C错）的功效是泻火除烦，清热利湿，凉血解毒，外用消肿止痛，焦栀子凉血止血。大青叶（D错）的功效是清热解毒，凉血消斑。薄荷（E错）的功效是疏散风热，清利头目，利咽透疹，疏肝行气。